止带方适用于带下病的哪种证候
A. 肾阳虚证
B. 阴虚夹湿热证
C. 脾虚证
D. 湿热下注证
E. 湿毒蕴结证

正确答案：D。湿热下注证

解析：带下病湿热下注证常见带下量多，色黄，气味臭秽，治法为清热利湿止带，方药为止带方（D对）。方中猪苓、茯苓、车前子、泽泻利水渗湿止带；赤芍、丹皮清热，凉血活血；黄柏、栀子、茵陈泻热解毒，燥湿止带；牛膝利水通淋，引诸药下行，使热清湿除带自止。带下过多肾阳虚用内补丸（A错）。带下过多阴虚夹湿热证用知柏地黄丸加芡实、金樱子（B错）。带下过多脾虚证用完带汤（C错）。带下过多湿毒蕴结证用五味消毒饮加土茯苓、薏苡仁、黄柏、茵陈（E错）。